构成宇宙本源的是
A. 天气
B. 精气
C. 阳气
D. 阴气
E. 地气

正确答案：B。精气

解析：中国古代哲学认为：宇宙万物是从无到有、从简单到复杂的一个演变过程。这个“无”即无形无象的客观存在，古人称之为精气，气是世界物质本原（B对）。